个别恒牙萌出过迟多与乳牙病变、过早脱落或滞留有关，最常见的乳牙过早脱落的牙应是
A. 上颌乳切牙
B. 上颌乳尖牙
C. 下颌乳切牙
D. 下颌乳尖牙
E. 上颌乳磨牙

正确答案：A。上颌乳切牙

解析：本题考查迟萌、多生牙和融合牙。个别恒牙萌出过迟多与乳牙病变、过早脱落或滞留有关，最常见的是上颌乳切牙（A对）过早脱落，儿童习惯用牙龈咀嚼，局部牙龈角化增生，变得坚韧肥厚，使恒牙萌出困难。